指压止血是指
A. 用手指压迫出血部位供应动脉的近心端
B. 用手指压迫出血部位供应动脉的远心端
C. 用手指压迫出血部位供应静脉的近心端
D. 用手指压迫出血部位供应静脉的远心端
E. 以上均不是

正确答案：A。用手指压迫出血部位供应动脉的近心端

解析：指压止血：用手指压迫出血部位供应动脉的近心端，适用于出血较多的紧急情况，作为暂时止血，然后再改用其他方法作进一步止血。掌握“口腔颌面部创伤急救”知识点。